表面活性剂可用作
A. 稀释剂
B. 增溶剂
C. 乳化剂
D. 润湿剂
E. 成膜剂

正确答案：B、C、D。增溶剂；乳化剂；润湿剂

解析：本题考查表面活性剂。表面活性剂可用作增溶剂（B对）、乳化剂（C对）、润湿剂（D对）、助悬剂、起泡剂和消泡剂、去污剂、消毒剂和杀菌剂。稀释剂（A错）为用来增加片剂的重量或体积的辅料，如淀粉；成膜剂（E错）为能够形成连续薄膜的聚合物。